解救大剂量甲氨蝶呤中毒
A. 亚叶酸钙
B. 地塞米松
C. 昂丹司琼
D. 氟他米特
E. L-门冬酰胺酶

正确答案：A。亚叶酸钙

解析：本题考查解救甲氨蝶呤中毒的药物。解救大剂量甲氨蝶呤中毒的是亚叶酸钙（A对）。解救大剂量甲氨蝶呤中毒的是甲酰四氢叶酸。地塞米松（B错）是糖皮质激素，具有抗炎、抗过敏、抗休克、抗风湿、免疫抑制作用。昂丹司琼（C错）用于肿瘤化疗、放疗引起的恶心、呕吐。氟他米特（D错）抑制雄激素对前列腺生长的刺激作用。L-门冬酰胺酶（E错）使肿瘤细胞不能从外界获得其生长所必需的氨基酸的药品。